呼吸性碱中毒的血气指标变化中，错误的是
A. PaC02继发性降低
B. AB、SB继发性降低
C. AB<SB
D. BB继发性降低
E. BE负值加大

正确答案：A。PaC02继发性降低

解析：呼吸性碱中毒时PaC02 原发性降低（A错，为本题正确答案），pH升高，AB<SB（B对），代偿后AB、SB（B对）及BB均降低（D对），BE负值加大（E对）。